女，45岁。间断胸骨后疼痛、反酸、烧心1年。饮酒后加重。查体：T36.5℃，P80次/分，R18次/分，BP120/80mmHg。浅表淋巴结未触及肿大，双肺呼吸音清，未闻及干湿啰音，心律齐，腹软，全腹无压痛及反跳痛。胃镜：食管下段可见长约0.3cm纵行黏膜破损。首选的治疗药物是
A. 碳酸氢钠
B. 奥美拉唑
C. 多潘立酮
D. 硫糖铝
E. 莫沙必利

正确答案：B。奥美拉唑

解析：中年女性患者，间断胸骨后疼痛、反酸、烧心1年（胃食管反流病的典型症状）及上腹胀等临床表现，胃镜检查见食管下段可见长约0.3cm纵行黏膜破损（提示患者为反流性食管炎的A级），诊断为胃食管反流病。奥美拉唑（B对）为质子泵抑制剂（PPI），适用于症状重、有严重食管炎的患者。碳酸氢钠（A错）、硫糖铝（D错）为弱碱性抗酸药，仅用于症状轻、间歇发作的患者临时缓解症状。多潘立酮（C错），莫沙必利（E错）都属于促胃肠动力药，可以通过增加食管下括约肌压力，改善食管蠕动，但这类药物疗效有限且不确定，因此只适用于轻症患者，或作为与抑酸药合用的辅助药。